下列药物引发的毒性反应，属于神经毒性的是
A. 西立伐他汀引起的横纹肌溶解
B. 环磷酰胺引起的骨髓抑制
C. 秋水仙碱引起的轴突损害
D. 庆大霉素引起的前庭毒性
E. 胺碘酮引起的髓鞘损害

正确答案：C、D、E。秋水仙碱引起的轴突损害；庆大霉素引起的前庭毒性；胺碘酮引起的髓鞘损害

解析：本题考查药物毒副作用。引起神经系统损害的药物有抗肿瘤药秋水仙碱（C对）、氨基糖苷类抗生素（D对）、有机磷酸酯类、抗心律失常药胺碘酮（E对）、抗结核药异烟肼、抗精神失常药氯丙嗪等。